DNA上某段碱基顺序为5'ATCGTTA3'，其互补链相对应的mRNA碱基顺序是
A. 5'TAGCAAT3'
B. 5'AUGCGUUA3'
C. 5'AUCGUUA3'
D. 3'UAGCAAU5'
E. 5'ATCGTTA3'

正确答案：C。5'AUCGUUA3'